目前认为环境内分泌干扰物的危害与下列某些疾病的发生发展有关，不正确的是
A. 某些癌症
B. 慢性阻塞性肺部疾患
C. 代谢紊乱
D. 出生缺陷
E. 生殖障碍

正确答案：B。慢性阻塞性肺部疾患

解析：本题考查环境内分泌干扰物的危害。内分泌干扰化学物是对维持机体内环境稳态和调节发育过程的体内天然激素的生成、释放、转运、代谢、结合、效应造成严重影响的一类外源性物质。目前认为内分泌干扰化学物与生殖障碍（E对）、出生缺陷（D对）、发育异常、代谢紊乱（C对）以及某些癌症（如乳腺癌、睾丸癌、卵巢癌等）（A对）的发生发展有关。环境内分泌干扰物的危害与慢性阻塞性肺部疾患（B错，为本题正确答案）无关。